在声压级的频率计权网络中，（）声级是为测量飞机噪声而设定的
A. A
B. B
C. C
D. D

正确答案：D。D

解析：本题考查声级的概念。计权网络通常有“A”“B”“C”“D”等几种。D（D对）计权网络是为测量飞机噪声而设计的，可直接用于测量飞机噪声强度。A（A错）计权网络模拟人耳对40方纯音的响应曲线，对低频段有较大幅度的衰减，对高频不衰减，国内外一般用A声级作为噪声的评价指标。B（B错）计权网络模拟人耳对70方纯音的响应曲线，对低频音有一定程度的衰减。C（C错）计权网络模拟人耳对100方纯音的响应特点，对所有频率的声音几乎都同等程度地通过，故可视作总声级。